人体试验道德的首要原则是
A. 医学目的原则
B. 随机对照原则
C. 信息公开原则
D. 知情同意原则
E. 维护受试者利益原则

正确答案：E。维护受试者利益原则

解析：强调对受试者利益的考虑必须高于对科学和社会利益的考虑，力求使受试者最大程度受益和尽可能避免伤害，这是人体试验最重要、最核心的伦理原则（E对）。